男性，40岁，有明显黄疸，皮肤瘙痒1个月，粪便颜色变浅，伴轻度乏力，腹胀，肝肋下触及2cm，脾侧卧未及，ALT120U/L，胆红素定量230umol/L，碱性磷酸酶、y-GT、胆固醇增高。有效的治疗措施是
A. 保肝治疗
B. 支持治疗
C. 消炎治疗
D. 皮质激素治疗
E. 调节免疫治疗

正确答案：D。皮质激素治疗

解析：中年男性，黄疸，皮肤瘙痒一个月，粪便颜色变浅（符合胆汁淤积性黄疸的临床表现），伴轻度乏力，腹胀，肝肋下触及2cm（提示肝脏增大），脾侧卧未及，ALT120U/L（正常值＜40U/L，提示存在肝功能损伤），胆红素定量230umol/L（正常值为3.4～14.1umol/L），碱性磷酸酶、γ-GT、胆固醇增高（实验室检查符合胆汁淤积性黄疸）。综合该患者的临床表现、症状和实验室检查，考虑为胆汁淤积型肝炎。该病治疗有以下几个方面①应用促胆汁排泄的药物，减轻胆管细胞炎症，减轻胆汁淤积；②如果伴有肝细胞炎症、转氨酶升高可以使用甘草酸制剂；③激素，其消炎作用非常突出，某些顽劣的胆汁淤积经过常规的利胆药物治疗之后，效果不明显者可以考虑用激素治疗（D对）；④必要时可以考虑血浆置换。